尖圆形的牙弓，上颌牙列自哪颗牙起就开始向后弯曲
A. 侧切牙
B. 尖牙
C. 前磨牙
D. 第一磨牙
E. 第二磨牙

正确答案：A。侧切牙

解析：尖圆形：上颌牙列自侧切牙起就开始向后弯曲，弓形牙列的前牙段向前突出比较明显。掌握“牙列”知识点。